儿童、青少年期哪种疾病与成年期心血管疾病的发生密切相关
A. 贫血
B. 肥胖
C. 龋齿
D. 近视
E. 营养不良

正确答案：B。肥胖